依据《中华人民共和国广告法》，广告经营者、广告发布者可不履行的义务或不承担的责任是
A. 在广告中使用无民事行为能力人的名义、形象的，应事先取得其监护人的书面同意
B. 依照法律、行政法规查验有关证明文件、核实广告内容
C. 按国家有关规定，建立、健全广告业务的承接登记、审核、档案管理制度
D. 收费标准和收费办法应向物价和工商管理部门备案，并予以公布
E. 发布虚假广告，误导消费者、使购买商品的消费者的合法权益受到损害，应承担全部民事责任

正确答案：E。发布虚假广告，误导消费者、使购买商品的消费者的合法权益受到损害，应承担全部民事责任

解析：本题考查《中华人民共和国广告法》。依据《中华人民共和国广告法》，广告经营者、广告发布者可不履行的义务或不承担的责任是发布虚假广告，误导消费者、使购买商品的消费者的合法权益受到损害，应承担全部民事责任（E对）。《中华人民共和国广告法》第五十六条：违反本法规定，发布虚假广告，欺骗和误导消费者，使购买商品或接受服务的消费者的合法权益受到损害的，由广告主依法承担民事责任。第三十三条：广告主或广告经营者在广告中使用他人名义、形象的，应当事先取得他人的书面同意；使用无民事行为能力人、限制民事行为能力人的名义、形象的，应当事先取得其监护人的书面同意（A错）。第三十四条，广告经营者、广告发布者依据法律、行政法规查验有关证明文件，核实广告内容（B错）。广告经营者、广告发布者按照国家有关规定，建立、健全广告业务的承接登记、审核、档案管理制度（C错）。第三十五条：广告经营者、广告发布者应当公布其收费标准和收费办法（D错）。